一甲亢患者，甲状腺肿大不明显，但食欲亢进消瘦血糖增高，医师忽视了甲状腺功能亢进的有关检查，最容易被误诊为
A. 结核病
B. 糖尿病
C. 恶性肿瘤
D. 败血症
E. 吸收不良综合征

正确答案：B。糖尿病

解析：甲亢患者，甲状腺肿大不明显，但食欲亢进消瘦血糖增高，医师忽视了甲状腺功能亢进的有关检查，最容易被误诊为糖尿病，所以医生在诊断疾病时应具有全面性（B对）。结核病应根据结核菌素实验来诊断（A错）。恶性肿瘤局部症状有肿块、出血、溃疡、疼痛、梗阻（C错）。败血症可反复出现的畏寒甚至寒战，高热可呈弛张型或间歇型，以瘀点为主的皮疹，累及大关节的关节痛，轻度的肝脾大，重者可有神志改变、心肌炎、感染性休克、弥散性血管内凝血（DIC）、呼吸窘迫综合征等（D错）。老年人容易发生吸收不良综合征，主要原因与老年人消化系统退行性变化有关，变化较显著的是胃、小肠和胰腺（E错）。